以下有关引起人类食物中毒的细菌不包括
A. 鼠伤寒沙门菌
B. 猪霍乱沙门菌
C. 变形杆菌
D. 肠炎沙门菌
E. 肺炎杆菌

正确答案：E。肺炎杆菌

解析：食物中毒，由鼠伤寒沙门菌、猪霍乱沙门菌、肠炎沙门菌等污染食物引起。掌握“志贺氏及沙门氏菌属”知识点。